患儿，2岁。发热2天，泪水汪汪，眼睑红赤，鼻塞流涕，喷嚏，咳嗽口腔两颊粘膜红赤，近臼齿处见细小白色疹点。治疗应首选
A. 凉营清气汤
B. 清胃解毒汤
C. 清解透表汤
D. 宣毒发表汤
E. 透疹凉解汤

正确答案：D。宣毒发表汤

解析：患儿发热，泪水汪汪，眼睑红赤，鼻塞流涕，喷嚏，其口腔内两颊近臼齿处出现麻疹黏膜斑，是麻疹早期诊断的依据。麻疹是感受麻疹时邪（麻疹病毒）引起的一种急性出疹性传染病，早期可辛凉透表，清宣肺卫，用宣毒发表汤（D对）。凉营清气汤适于毒炽气营的猩红热（A错）。清胃解毒汤适于邪炽气营的水痘（B错）。清解透表汤适于邪入肺胃的麻疹的出疹期（C错）。透疹凉解汤适于邪入气营的风疹（E错）。